BCG属于
A. 死菌苗
B. 类毒素
C. 减毒活疫苗
D. 抗毒素
E. 荚膜多糖疫苗

正确答案：C。减毒活疫苗

解析：本题考查疫苗的种类。BCG（卡介苗）属于减毒活疫苗（C对）。死菌苗（A错）是选用免疫原性强的病原体，经人工大量培养后，用理化方法灭活制成；死疫苗主要诱导特异抗体的产生，为维持血清抗体水平，常需多次接种，有时会引起较重的注射局部和全身反应。类毒素（B错）是用细菌的外毒素经0.3％～0.4％甲醛处理制成，因其已失去外毒素的毒性，但保留免疫原性，接种后能诱导机体产生抗毒素。抗毒素（D错）是特异性抗体，进行人体注射可使机体被动获得适应性免疫应答，主要用于治疗和紧急预防细菌外毒素所致疾病。荚膜多糖疫苗（E错）中的细菌荚膜多糖属于T1抗原，不需T细胞辅助即可直接刺激B细胞产生IgM类抗体，对婴幼儿的免疫效果很差。